男，75岁。眩晕日久不愈，精神萎靡，腰酸膝软，少寐多梦，健忘，两目干涩，视力减退，舌红少苔，脉细数。该病例辨证分型是
A. 肾精不足
B. 肝阳上亢
C. 气血亏虚
D. 痰湿中阻
E. 瘀血阻窍

正确答案：A。肾精不足

解析：精髓不足，不能上充于脑，故出现眩晕、精神萎靡；肾虚则心肾不交，故少寐多梦、健忘；腰为肾之府，肾虚则腰膝酸软；偏于阴虚则两目干涩，舌红少苔，脉细数；故可辨证为肾经不足证（A对）。眩晕之肝阳上亢证症状：眩晕耳鸣，头胀痛，急躁易怒，失眠多梦，脉弦，或兼面红，目赤，口苦，便秘尿赤，舌红苔黄，脉弦数；或兼腰膝酸软，健忘，遗精，舌红少苔，脉弦细而数，甚或眩晕欲仆，泛泛欲呕，头痛如掣，肢麻震颤，语言不利，步履不正（B错）。眩晕之气血亏虚证症状：眩晕，动则加剧，劳累即发，神疲懒言，气短声低，面白少华，心悸失眠，纳减，或兼食后腹胀，大便潇薄，或兼畏寒肢冷，唇甲淡白，或兼诸失血症，舌质淡胖嫩，边有齿印，苔少或厚，脉细或虚大（C错）。眩晕之痰湿中阻证症状：眩晕，倦怠或头重如蒙，胸闷恶心，呕吐痰涎，少食多寐，舌胖，苔白腻，脉弦滑（D错）。眩晕之瘀血阻窍证症状：眩晕，头痛，兼见健忘，失眠，心悸，精神不振，耳聋耳鸣，面唇紫暗，舌暗有瘀斑，脉涩或细涩（E错）。